男，25岁。1年来反复镜下血尿，相差显微镜检查为变形红细胞，尿蛋白0.4g/d，无水肿、高血压及肾功能减退。应首先考虑的诊断为
A. 无症状性蛋白尿和（或）血尿
B. 急性肾小球肾炎
C. 泌尿系统肿瘤
D. 慢性肾小球肾炎
E. 尿路结石

正确答案：A。无症状性蛋白尿和（或）血尿

解析：青年男性患者1年来反复镜下血尿，相差显微镜检查为变形红细胞（提示肾小球源性血尿），尿蛋白0.4g/d，无水肿、高血压及肾功能减退，符合无症状性蛋白尿和（或）血尿（A对）临床症状。急性肾小球肾炎（B错）常有前驱感染史，特点为急性起病，患者出现血尿、蛋白尿、水肿和高血压，并可伴有一过性肾功能不全。泌尿系统肿瘤（C错）可表现为无痛性血尿（非肾小球源性，红细胞形态正常）、疼痛和肿块。慢性肾小球肾炎（D错）系指蛋白尿、血尿、高血压、水肿为基本临床表现，起病方式各有不同，病情迁延，病变缓慢进展，可有不同程度的肾功能减退，最终将发展为慢性肾衰竭的一组肾小球病。尿路结石（E错）分上、下尿路结石，上尿路结石可有疼痛、血尿（非肾小球源性，红细胞形态正常）、恶心、呕吐、膀胱刺激征，下尿路结石典型症状为排尿突然中断，疼痛反射至远端尿道及阴茎头部，伴排尿困难和膀胱刺激症状。